含有副交感纤维
A. 副神经
B. 展神经
C. 三叉神经
D. 舌下神经
E. 动眼神经

正确答案：E。动眼神经

解析：脑神经中的内脏运动纤维，属于副交感成分，且仅存在于Ⅲ、VII、IX、X四对脑神经中，包括动眼神经（E对）、面神经、舌咽神经、迷走神经。